化学结构、抗菌作用和抗菌机制均与磺胺类药物相似的抗麻风病药物是
A. 利福平
B. 氯法齐明
C. 沙利度胺
D. 阿奇霉素
E. 氨苯砜

正确答案：E。氨苯砜